男，6岁。身高80cm，智能落后，仅能数1～20个数。体检：皮肤粗糙，毛发枯干，表情呆板，腹隆，四肢短小，骨龄摄片仅有4枚骨化核。为确诊应做的检查是
A. 智能测定
B. 血清T₃、T₄、TSH测定
C. 尿甲苯胺蓝试验
D. 尿三氯化铁试验
E. 血清生长激素测定

正确答案：B。血清T₃、T₄、TSH测定

解析：患儿6岁，身高仅有80cm，表现为身材矮小且智能落后。体检发现皮肤粗糙、毛发干枯，呈“黏液水肿性”综合征。且骨龄摄片仅有4 枚骨化核提示骨生长发育不良。以上症状均为甲状腺功能低下的常见症状，初步诊断为先天性甲低，应查血清T3、T4、TSH测定以明确诊断（B对）。智能测定（A错）可用于唐氏综合征初诊；尿三氯化铁试验（D错）用于诊断苯丙酮尿症；血清生长激素测定（E错）用于诊断侏儒症和巨人症；尿甲苯胺蓝试验（C错）不用于先天性甲低的诊断。